正确描述上腔静脉的是
A. 由左、右头静脉合成
B. 收纳奇静脉和半奇静脉
C. 由左、右头臂静脉合成
D. 注入左心房
E. 收纳入右奇静脉

正确答案：C。由左、右头臂静脉合成

解析：上腔静脉由左、右头臂静脉（C对A错）汇合而成。其收纳奇静脉（BE错）。注入右心房（D错）。